属喹喏里西啶衍生物的是
A. 氧化苦参碱
B. 樟柳碱
C. 莨菪碱
D. 黄连碱
E. 乌头碱

正确答案：A。氧化苦参碱

解析：本题考查的是苦参中主要生物碱及其化学结构。属喹喏里西啶衍生物的是氧化苦参碱（A对）。苦参所含主要生物碱是苦参碱和氧化苦参碱，《中国药典》以其为指标成分进行鉴别和含量测定，含量测定要求苦参碱和氧化苦参碱总量不得少于1.2%。此外还含有羟基苦参碱、N-甲基金雀花碱、安那吉碱、巴普叶碱和去氢苦参碱（苦参烯碱）等。这些生物碱都属于双稠哌啶类，具喹喏里西啶的基本结构。樟柳碱（B错）与莨菪碱（C错）为洋金花的主要化学成分，属于莨菪烷类生物碱。洋金花主要化学成分为莨菪烷类生物碱，由莨菪醇类和芳香族有机酸结合生成的一元酯类化合物。主要有莨菪碱（阿托品）、山莨菪碱、东莨菪碱、樟柳碱和N-去甲莨菪碱。《中国药典》以东莨菪碱为指标成分进行含量测定，要求东莨菪碱不得少于0.15%。黄连碱（D错）为黄连的主要化学成分，属于季铵型生物碱。黄连的有效成分主要是生物碱，已经分离出来的生物碱有小檗碱（含量最高）、巴马汀、黄连碱、甲基黄连碱、药根碱和木兰碱（属于阿朴啡型）等；大多属苄基异喹啉类衍生物，季铵型生物碱。《中国药典》以小檗碱为指标成分进行含量测定。以盐酸小檗碱计，要求味连含小檗碱不得少于5.5%，表小檗碱不得少于0.80%，黄连碱不得少于1.6%，巴马汀不得少于1.5%；要求雅连含小檗碱不得少于4.5%；要求云连含小檗碱不得少于7.0%。乌头碱（E错）为川乌的主要化学成分，属于二萜双酯型生物碱。川乌中主要毒性生物碱及其化学结构：乌头和附子主要含二萜类生物碱，属于四环或五环二萜类衍生物。乌头生物碱的结构复杂、结构类型多。其重要和含量较高的有乌头碱、次乌头碱和新乌头碱。《中国药典》以三者为指标成分进行含量测定，要求三者总量应为0.050～0.17%。由于C₁₄和C₈的羟基常和乙酸、苯甲酸结合成酯，故称它们为二萜双酯型生物碱。